患者，女，22岁。恶寒，高热，咳嗽，胸痛l天。入院检查：体温38.6℃，脉搏100次/分，X线胸片示右下肺片状阴影，血白细胞21×10⁹/L，中性粒细胞87%。应首先考虑的是
A. 肺炎球菌肺炎
B. 休克型肺炎
C. 支原体肺炎
D. 病毒性肺炎
E. 肺脓肿

正确答案：A。肺炎球菌肺炎

解析：肺炎球菌肺炎起病多急骤，高热，寒战，数小时内体温升至39℃～40℃，或呈稽留热，全身肌肉酸痛；胸痛，并可放射至肩部或腹部；咳嗽，咳痰，但痰少，可带血或呈铁锈色；食欲差，偶有恶心、腹痛或腹泻，可被误诊为急腹症。目前典型症状并不多见（A对）。休克型肺炎临床主要有肺部感染和休克的表现。多数患者有咳嗽、咳痰，全身不适；肺部体征多不典型。休克常突然发生，表现为：血压下降、面色苍白、四肢厥冷、冷汗淋漓、脉搏细速、口唇及肢体皮肤紫绀、尿少或无尿、表情淡漠、意识模糊不清、烦躁不安、或嗜睡甚至昏迷（B错）。肺炎支原体肺炎通常起病较缓慢。症状主要为乏力、咽痛、头痛、咳嗽、发热、食欲不振、腹泻、肌痛、耳痛等。咳嗽多为阵发性刺激性呛咳，咳少量黏液。发热可持续2～3周，体温恢复正常后可能仍有咳嗽（C错）。好发于病毒性疾病流行季节，临床症状通常较轻，与支原体肺炎的症状相似，但起病较急，发热、头痛、全身酸痛、倦怠等较突出，常在急性流感症状尚未消退时，即出现咳嗽、少痰或白色黏液痰、咽痛等呼吸道症状（D错）。肺脓肿是肺组织坏死形成的脓腔，它是由多种病原菌引起的肺部化脓性感染性疾病。早期为肺组织的感染性炎症，继而坏死、液化，由肉芽组织包裹形成脓肿。临床以高热、咳嗽、略大量脓臭痰为特征（E错）。